高血压脑出血的好发部位是
A. 中脑
B. 小脑
C. 基底节
D. 脑室
E. 脑桥

正确答案：C。基底节

解析：高血压的脑血管病变部位，特别容易发生在大脑中动脉的豆纹动脉、基底动脉（C对）的旁正中动脉和小脑齿状核动脉。脑出血之所以多见于基底节区域（尤以豆状核区最多见），是因为供应该区域的豆纹动脉从大脑中动脉呈直角分支，直接受到大脑中动脉压力较高的血流冲击和牵引，致豆纹纹动脉易破裂出血（九版病理学P165）。因此高血压脑出血的好发部位是基底节（C对）。